矿石类的安神药，如作丸散服，须酌情配伍
A. 补血药
B. 行气药
C. 活血药
D. 养胃健脾药
E. 养阴补血药

正确答案：D。养胃健脾药

解析：本题考查的是矿石类安神药的临床应用。矿石类的安神药，如作丸散服，须酌情配伍健脾养胃药（D对）。矿石类安神药易伤脾胃，不宜久服，或配伍健脾养胃药同用；用治失眠，应于临睡前服药。补血药（A错）功主养血，兼能滋阴，主治血虚、阴血亏虚等证。行气（B错）为紫苏、厚朴、砂仁、白豆蔻、草豆蔻、荜茇、木香、沉香、川楝子、乌药、荔枝核等的功效。活血药（C错）指以通利血脉、促进血行、消散瘀血为主要功效的药物，又称为活血祛瘀药或活血化瘀药。养阴补血（E错）为熟地黄、阿胶、桑椹等的功效。